生命质量评价主要应用于
A. 慢性病
B. 急性病
C. 老年人
D. 一般人群
E. 慢性病和其他有一定生命数量基础的人群

正确答案：E。慢性病和其他有一定生命数量基础的人群

解析：本题考查生命质量评价的应用。生命质量评价主要应用于慢性病和其他有一定生命数量基础的人群（E对ABCD错）。